审方时要关注中西药联用的情况，下列药品中含有西药成分的有
A. 鼻炎康片
B. 珍菊降压片
C. 防风通圣丸
D. 蛇胆川贝液
E. 消渴丸

正确答案：A、B、E。鼻炎康片；珍菊降压片；消渴丸

解析：本题考查中成药。下列药品中含有西药成分的有鼻炎康片（A对）、珍菊降压片（B对）、消渴丸（E对）。鼻炎康片为中成药，含西药马来酸氯苯那敏。珍菊降压片为中成药，含西药成分为盐酸可乐定、氢氯噻嗪。消渴丸为中成药，含西药格列本脲。防风通圣丸（C错）、蛇胆川贝液（D错）均不含西药成分。